抑制经典途径和替代途径C3转化酶和C5转化酶形成与活性的是
A. S蛋白
B. IgM与抗原结合形成的复合物
C. P因子
D. MBL
E. DAF

正确答案：E。DAF